伤寒病可有
A. 玫瑰疹
B. 皮肤瘀点、瘀斑
C. 淋巴结肿大
D. 关节痛
E. 少尿

正确答案：A。玫瑰疹

解析：伤寒，又称“肠热病”，是由伤寒杆菌引起的一种急性肠道传染病。临床特征为持续性发热、表情淡漠、相对缓脉、玫瑰疹（A对）、肝脾肿大及白细胞减少等。肠出血和肠穿孔等是其常见严重并发症。伤寒患者在极期出现典型临床表现，半数患者在病程第7～14天皮肤出现淡红色斑丘瘆，称为玫瑰疹，直径约2～4mm，压之退色，多在10个以下，分批出现，主要分布于胸、腹及肩背部，四肢少见，常于2～4天内变淡、消失。皮肤瘀点、瘀斑（B错）为流行性脑脊髓膜炎的特殊皮肤改变，而伤寒病的皮肤改变为典型的玫瑰疹。淋巴结肿大（C错）、关节痛（D错）、少尿（E错）等临床表现并非伤寒的典型临床表现。